黑膏药制备工艺流程中的“去火毒”工序是
A. 在药料提取前
B. 在药料提取后
C. 在炼油过程中
D. 在下丹成膏时
E. 在下丹成膏后

正确答案：E。在下丹成膏后

解析：本题考查的是黑膏药的制备工艺流程。黑膏药制备工艺流程中的“去火毒”工序是在下丹成膏后（E对）。黑膏药的制备工艺流程为：1.原料的选择与处理。油要选麻油，饮片适当粉碎。2.炸药。将油微热，投入物料，加热搅拌，炸至饮片呈黄褐色。炸好后，用漏勺捞去药渣。3.炼油。取出药渣后的油要继续进行炼制，先用小火，后用大火加热至320℃。4.下丹成膏。油脂在高温时，加入铅丹，则反应生成脂肪酸铅盐，同时铅盐又促使油脂氧化、聚合、增稠而成膏。5.去“火毒”。将熬好的膏药倒入清水盆，倒的时候将水朝一个方向搅转时膏药聚集成团。浸泡3-7天。并每日更换新水去火毒。